血清甲胎蛋白阳性最常见的疾病是
A. 生殖腺胚胎肿瘤
B. 原发性肝癌
C. 肝硬化
D. 转移性肝癌
E. 卵巢癌

正确答案：B。原发性肝癌

解析：一般来说如果甲胎蛋白超过200，持续八个月，肿瘤的可能性就很大，就需要进行肝脏彩超或者肝脏磁共振等方面的检查，排除一些肝脏肿瘤的可能性。在肝功能不正常的时候甲胎蛋白的偏高往往提示肝细胞在损伤和修复的过程中，需要针对甲胎蛋白的阳性还需要结合其他的病史来进行综合的分析。故血清甲胎蛋白阳性最常见的疾病是原发性肝癌（B对CD错）。癌胚抗原CEA最常见的疾病生殖腺胚胎肿瘤、卵巢癌（AE错）。